诊断小儿肾病综合征的必备条件是
A. 明显水肿及低蛋白血症
B. 明显水肿及大量蛋白尿
C. 明显水肿及高脂血症
D. 大量蛋白尿及高脂血症
E. 大量蛋白尿及低蛋白血症

正确答案：E。大量蛋白尿及低蛋白血症

解析：大量蛋白尿及低蛋白血症是诊断小儿肾病综合征的必备条件。肾病综合症的肾小球基底膜通透性增加，大量的血浆蛋白从尿中丢失，导致低蛋白血症。在低蛋白血症的基础上，血浆蛋白的降低促进了肝脏合成脂蛋白，其中的大分子脂蛋白难从肾脏排除而蓄积在体内，形成高脂血症。当血浆白蛋白下降到一定的区间时，液体将会在机体较疏松的组织（如眼睑）蓄积出现水肿症状。并由于血容量降低刺激机体水、钠重吸收增加，使得水肿进一步加重。由此可见大量蛋白尿和低蛋白血症（E对）是形成明显水肿和高脂血症的基础，也是诊断小儿肾病综合症的必备条件。